关于肿瘤发病预测模型的研究为
A. 现况研究
B. 病例对照研究
C. 队列研究
D. 实验流行病学
E. 理论流行病学

正确答案：E。理论流行病学

解析：本题考查理论流行病学的应用。理论流行病学（E对ABCD错）的应用：1.研究疾病流行特征的模型：疾病的流行特征主要包括疾病的流行过程、人群、时间、空间的分布等，历史上第一个流行病学数学模型的研究就是从研究流行特征开始，即Ross建立疟疾的传播模型。2.用于疾病预测（肿瘤发病预测模型）的模型。3.用于效果评价的数学模型。